直接盖髓术最重要的注意事项是
A. 无痛术
B. 动作轻巧
C. 去净腐质
D. 无菌操作
E. 充分止血

正确答案：D。无菌操作

解析：本题考查直接盖髓术的注意事项。术中的无菌操作（D对）是直接盖髓术成功的保证，必须严格消毒无菌，一旦被污染，牙髓可能会呈慢性炎症状态，出现牙内吸收、钙化、渐近性坏死，导致手术失败。无痛术（A错）、动作轻巧（B错）、去净腐质（C错）、充分止血（E错）是直接盖髓术的基本要求，有利于减轻患者痛苦，使视野清晰等，但是无菌操作是重中之重。